某男65岁，患有高血压病，长期服用卡托普利，但近期出现干咳副作用，下列药物中适合该患者的替代药物有
A. 福辛普利
B. 马来酸依那普利
C. 氯沙坦
D. 右丙氧芬
E. 缬沙坦

正确答案：C、E。氯沙坦；缬沙坦